公共场所“卫生许可证”是由哪个部门签发
A. 各级疾病控制中心
B. 各级卫生监督所
C. 卫生部
D. 县级以上卫生行政部门
E. 工商行政管理部门

正确答案：D。县级以上卫生行政部门

解析：本题考查公共场所“卫生许可证”的签发部门。卫生许可证是卫生行政部门在开业之前，依据经营者申请进行预防性卫生监督之后，认为所经营的项目符合卫生标准和要求而制发的卫生许可证明书。公共场所“卫生许可证”是由县级以上卫生行政部门（D对ABCE错）签发。县级及以上地方人民政府卫生行政部门应当自受理公共场所卫生许可申请之日起20日内，对申报资料进行审查，对现场进行审核，符合规定条件的，作出准予公共场所卫生许可的决定。